下列哪项不是外科感染的特点
A. 多由几种细菌引起的混合感染
B. 常有明显的局部症状
C. 病变往往集中在某个局部，而后化脓，坏死
D. 不会引起严重的全身感染
E. 一般指需要手术治疗的感染性疾病

正确答案：D。不会引起严重的全身感染

解析：外科感染分为局部感染和全身感染，感染轻微可无全身症状，感染严重时可以产生全身的炎症反应。掌握“外科感染”知识点。